牙槽嵴骨组织改建的程度在拔牙后多长时间内变化最大
A. 1个月
B. 2个月
C. 3个月
D. 4个月
E. 6个月

正确答案：C。3个月

解析：牙槽嵴骨组织改建的程度在拔牙后前3个月内变化最大，6个月时拔牙窝完全愈合，骨吸收速度显著下降，拔牙后2年吸收速度趋缓，平均吸收速度约为每年0.5mm，缺牙时间越长，牙槽嵴吸收越多。掌握“牙列缺失后的病因及影响”知识点。